采样测定工作场所化学毒物或粉尘的浓度，反映个体接触水平，宜采用
A. TWA
B. MAC
C. TLV-C
D. STEL
E. PELs

正确答案：A。TWA